水中氯化物过多时呈
A. 苦味
B. 收敛味
C. 涩味
D. 沼泽味
E. 咸味

正确答案：E。咸味

解析：本题考查水质的物理性状指标的相关内容。水中氯化物过多时呈咸味（E对ABCD错）。